某大学二年级学生，因爸爸经常在家抽烟，他从高中就开始尝试吸烟，现在每天都会抽上1-2支。新学期一开始，学校就公布了新的奖励制度，明确规定吸烟学生不得授予奖学金和优秀称号。他便成功戒烟。学校对吸烟学生采用的干预措施是
A. 健康教育
B. 同伴教育
C. 生活技能教育
D. 支持性政策
E. 改善环境

正确答案：D。支持性政策